侵蚀性葡萄胎与葡萄胎病理的主要区别点是
A. 绒毛细胞滋养层细胞
B. 绒毛合体滋养层细胞增生
C. 子宫深肌层见水疱状绒毛
D. 绒毛间质血管消失
E. 绒毛水肿呈水疱状

正确答案：C。子宫深肌层见水疱状绒毛

解析：侵蚀性葡萄胎与葡萄胎病理的主要区别点是水泡状绒毛侵入子宫肌层，即子宫深肌层见水疱状绒毛（C对），引起子宫肌层出血坏死，甚至向子宫外侵袭累及阔韧带，或经血管栓塞至阴道、肺和脑等远隔器官。绒毛细胞滋养层细胞增生（A错）、绒毛合体滋养层细胞增生（B错）、绒毛间质血管消失（D错）、绒毛水肿呈水疱状（E错）为葡萄胎的病理特点（P287）。